联苯胺主要职业危害是引起
A. 膀胱癌
B. 白血病
C. 肺癌
D. 皮肤癌
E. 肝癌

正确答案：A。膀胱癌

解析：本题考查联苯胺的致癌类型。联苯胺及其盐类可经呼吸道、胃肠道、皮肤进入人体，最终在膀胱蓄积导致膀胱癌（A对BCDE错）。